女性，25岁，低热，便秘腹泻交替3年，查：右下腹5cm×5cm肿块，质中等，较固定，轻压痛。最有可能的是
A. 结肠癌
B. 肠结核
C. 克罗恩病
D. 溃疡性结肠炎
E. 肠血吸虫病

正确答案：B。肠结核

解析：青年女性患者，有低热等结核中毒症状，腹泻便秘交替（肠结核可表现为腹泻与便秘交替）3年。查体：右下腹包块，固定轻压痛（多见于增生型肠结核）。综合患者病史与查体，考虑诊断为肠结核（B对）。结肠癌（P382）（A错）好发于40～60岁，多有便血症状，若有腹部肿块提示已届中晚期，而中晚期患者会有进行性消瘦、恶病质、腹水等表现。克罗恩病（P377）（C错）临床以腹痛、腹泻、体重下降、腹块、瘘管形成和肠梗阻为特点。溃疡性结肠炎（P374）（D错）病变多自直肠逆行向上，临床以腹泻、黏液脓血便及左下腹痛为特征。肠血吸虫病（E错）应有明确血吸虫感染史，临床以腹痛、黏液脓血便、消瘦、乏力、劳动力减退为特征。